下列疾病中不会发生母婴垂直传播的为
A. 梅毒
B. 甲型肝炎
C. 艾滋病
D. 乙型肝炎
E. 弓形虫病

正确答案：B。甲型肝炎